我国食品中的AFB₁允许量规定大米及其他食用油
A. ≤10μg/kg
B. ≤20μg/kg
C. ≤5μg/kg
D. ≤15μg/kg
E. 不得检出

正确答案：A。≤10μg/kg